吉法酯片治疗消化性溃疡，正确的用药方法是
A. 餐后半小时服用
B. 清晨空腹整片吞服，并保持上身直立的坐位或站位至少30分钟
C. 睡前服用
D. 餐前1小时嚼碎服用
E. 进餐时整片吞服

正确答案：A。餐后半小时服用

解析：本题考查吉法酯片的使用。吉法酯片餐后半小时服用（A对）。吉法酯是一种黏膜保护剂，可促进胃黏膜-黏液分泌与内源性前列腺素生成，增加胃黏膜血流，促进溃疡修复愈合。吉法酯餐后服用生物利用度高。